目前对HEV的预防措施主要是
A. 注射丙种球蛋白
B. 接种灭活疫苗
C. 接种减毒活疫苗
D. 加强血制品的检测
E. 切断粪-口传播途径

正确答案：E。切断粪-口传播途径

解析：目前无戊型肝炎疫苗，预防戊型肝炎采用一般肠道病毒病的预防措施，即切断粪-口传播途径为主的措施。掌握“丙型、丁型、戊型肝炎病毒”知识点。